颌面部放线菌病软组织好发部位多见于
A. 颊部
B. 舌部
C. 颈部
D. 下颌下
E. 腮腺咬肌区

正确答案：E。腮腺咬肌区

解析：本题考查颌面部骨结核、放线菌病。颌面部放线菌病临床表现：以20～45岁的男性多见。发生于面颈部的放线菌病占全身的60%以上。颌面部放线菌病主要发生于面部软组织，软组织与颌骨同时受累者仅占20%。软组织好发部位以腮腺咬肌区（E对）为多，其次是下颌下（D错）、颈（C错）、舌（B错）及颊部（A错）；颌骨的放线菌病则以下颌角及下颌支为多见。